属于静止期杀菌的抗生素有
A. 氨基糖苷类
B. 四环素类
C. 青霉素类
D. 大环内酯类
E. 多黏菌素

正确答案：A、E。氨基糖苷类；多黏菌素

解析：本题考查静止期杀菌的抗生素。属于静止期杀菌的抗生素有氨基糖苷类（A对）和多黏菌素（E对）。氨基糖苷类药为浓度依赖型速效杀菌剂，对繁殖期和静止期的细菌均有杀菌作用。多黏菌素属于静止期杀菌药。大环内脂类抗生素（D错）为速效抑菌药。四环素类（B错）抗菌药物仅适用于少数敏感细菌及衣原体属、立克次体等不典型病原体所致感染。青霉素类（C错）对繁殖期细菌作用明显，对静止期细菌影响较小。